下壁心肌梗死的心电图表现是
A. Ⅱ、Ⅲ、aVF导联有病理性Q波
B. V₁、V₂、V₃有病理性Q波
C. V₄、V₅、V₆有病理性Q波
D. V₇、V₈有病理性Q波
E. ⅠaVL导联有病理性Q波

正确答案：A。Ⅱ、Ⅲ、aVF导联有病理性Q波

解析：急性下壁心肌梗死时心电图示ⅡⅢaVF病理性Q波及ST段上移（A对）。前间隔V₁～V₃有病理性Q波（B错）。侧壁V₅～V₆有病理性Q波（C错）。正后壁V₇～V₉有病理性Q波（D错）。侧壁ⅠaVL有病理性Q波及ST段上移（E错）。